湿热蕴脾可见的口味是
A. 口淡乏味
B. 口甜黏腻
C. 口咸
D. 口中泛酸
E. 口苦

正确答案：B。口甜黏腻

解析：口甜指患者口中有甜味感，多与脾胃病有关。若口中甜而胶黏，脘闷不舒，舌苔黄腻者，为脾胃湿热。因湿热内阻，脾胃升降失职，浊气上蒸，故见口甜（B对）。若口甜而食少，神疲乏力者，为脾虚，因甘味入脾，脾气虚则甘味上泛之故。口酸指患者口中泛酸水或有酸馈味，属肝胃郁热，或伤食证。若患者口中泛吐酸水，嗳气不适，脘腹疼痛者，多因肝火横逆犯胃，木郁作酸（D错），故见泛吐酸水。若患者口中有酸馊味，口气酸臭者，多因暴饮暴食，损伤胃肠，食积不化，胃中浊气上泛所致。口淡指患者味觉减退，口中乏味，常伴食欲减退，属脾胃虚弱，或寒湿内阻。因脾胃虚弱，运化腐熟功能低下，或寒湿内停，阴不耗液，故口淡不渴（A错）。口咸指患者自觉口中有咸味，见于肾虚或寒证。因咸入肾，肾阴不足，虚火上炎；又或肾阳亏虚，寒水上泛，皆可令口中有咸味（C错）。口苦指患者自觉口中有苦味，见千实热证，尤以心、肝、胆火旺者多见。心烦失眠者，常有口苦，乃心火上炎之故；胆汁味苦，故肝火上炎或胆气上泛，皆可致口苦（E错）。